关于药典的说法错误的是
A. 药典是记载国家药品标准的主要形式
B. 《中国药典》二部不收载化学药品的用法与用量
C. 《美国药典》与《美国国家处方集》合并出版，英文缩写为USP-NF
D. 《英国药典》不收载植物药和辅助治疗药
E. 《欧洲药典》收载有制剂通则但不收载制剂品种

正确答案：D。《英国药典》不收载植物药和辅助治疗药

解析：本题考查药典。关于药典的说法错误的是《英国药典》不收载植物药和辅助治疗药（D错，为本题正确答案）。《英国药典》第4卷收载植物药和辅助治疗药、血液制品、免疫制品、放射性药物，以及手术用品。药典是记载国家药品标准的主要形式（A对）。《中国药典》二部分两部分收载化学药品：第一部分收载化学药品、抗生素、生化药品及各类药物制剂（列于原料药之后）；第二部分收载放射性药物制剂（B对）。《美国药典》与《美国国家处方集》合并出版，《美国药典-国家处方集》英文缩写为USP-NF（C对）。《欧洲药典》不收载（化学药物）制剂，但收载有（化学药物）制剂通则（E对），包括定义 、生产和检查 ，分别记载有与制剂剂型特点相关的一般要求。